女性，18岁。苍白，月经过多2个月。肝肋下及边，质软，脾肋下未及。血红蛋白60g/L，白细胞2.7×10⁹/L，血小板30×10⁹/L。分别在髂前及髂后上棘进行骨骼穿刺，取材不满意，胸骨穿刺增生活跃，粒细胞、红细胞二系成熟停滞于晚期，全片未见巨核细胞。最可能的诊断是
A. 特发性血小板减少性紫癜
B. 缺铁性贫血
C. 急性白血病
D. 再生障碍性贫血
E. 骨髓纤维化

正确答案：D。再生障碍性贫血